某医疗机构应用传统工艺配制中药制剂未依照《中医药法》规定备案，药品监督管理部门应当对其违法行为作出的认定是
A. 按生产假药处罚
B. 按生产劣药处罚
C. 按无证生产处罚
D. 按未遵守《药品生产质量管理规范》处罚

正确答案：A。按生产假药处罚

解析：本题考查违反《中医药法》的法律责任。某医疗机构应用传统工艺配制中药制剂未依照《中医药法》规定备案，药品监督管理部门应当对其违法行为作出的认定是按生产假药处罚（A对）。医疗机构应用传统工艺配制中药制剂未依照本法规定备案，或者未按照备案材料载明的要求配制中药制剂的，按生产假药给予处罚。